具有透疹作用的药组是
A. 蝉蜕、金银花、菊花
B. 薄荷、葛根、升麻
C. 紫草、牛蒡子、防风
D. 桑叶、薄荷、菊花
E. 荆芥、连翘、升麻

正确答案：B。薄荷、葛根、升麻

解析：蝉蜕的功效是疏散风热，利咽开音，透疹，明目退翳，息风止痉；金银花的功效是清热解毒，疏散风热；菊花的功效是疏散风热，平抑肝阳，清肝明目，清热解毒（A错）。薄荷的功效是疏散风热，清利头目，利咽透疹，疏肝行气；葛根的功效是解肌退热，透疹，生津止渴，升阳止泻；升麻的功效是解表透疹，清热解毒，升举阳气三者均具有透疹的作用（B对）。紫草的功效是清热凉血，活血，解毒透疹；防风的功效是祛风解表，胜湿止痛，止痉；牛蒡子的功效是疏散风热，宣肺祛痰，利咽透疹，解毒消肿（C错）。桑叶的功效是疏散风热，清肺润燥，平抑肝阳，清肝明目（D错）。荆芥的功效是祛风解表，透疹消疮，止血；连翘的功效是清热解毒，消肿散结，疏散风热（E错）。